男，30岁。不洁饮食后出现反复大量呕吐。最可能出现的水电解质失调是
A. 等渗性缺水
B. 低镁血症
C. 高渗性缺水
D. 稀释性低钠血症
E. 高钾血症

正确答案：A。等渗性缺水

解析：该患者不洁饮食后出现反复大量呕吐，属于消化液的急性丧失，最可能引发等渗性缺水（A对）。低镁血症（P15）（B错）的主要原因为饥饿、吸收障碍综合征、长时期的胃肠道消化液丧失（如肠瘘）以及长期静脉输液中不含镁等。高渗性缺水（P11）（C错）是指失水多于失钠，主要病因为长期摄入水分不够或水分丧失过多，较等渗性缺水少见。稀释性低钠血症（D错）又称水中毒，多因抗利尿激素分泌增多，肾功能不全，水摄入过多等引起。大量呕吐时钾盐随消化液大量丢失，会出现低钾血症，而非高钾血症（E错）。